甲肝的传染源主要是
A. 急性期病人
B. 健康携带者
C. 急性期病人和健康携带者
D. 受感染的动物
E. 慢性病原携带者

正确答案：C。急性期病人和健康携带者